经产妇，26岁。妊娠37周，晨起发现阴道流血，无明显腹痛，检查有宫缩，查体子宫大小大于孕周数，胎心存在。对确诊有价值检查的结果是
A. 贫血程度与阴道流血量不相符
B. 贫血程度与阴道流血量相符
C. 伴休克
D. 宫颈管消失
E. 胎位不正

正确答案：B。贫血程度与阴道流血量相符

解析：青年经产妇，妊娠37周（妊娠28周及以后称为妊娠晚期），晨起发现阴道流血，无明显腹痛（前置胎盘的典型症状为妊娠晚期或临产时，发生无诱因、无痛性反复阴道流血），最可能诊断为前置胎盘，前置胎盘患者的贫血程度与阴道流血量相符（B对A错）。休克（C错）见于Ⅲ度胎盘早剥。宫颈管消失（D错）是临产前的变化，该孕妇尚未临产。前置胎盘由于子宫下段有胎盘占据，影响胎先露部入盆，胎先露高浮，常并发胎位不正（E错），但其不是确诊有价值的结果。